甲型肝炎及戊型肝炎
A. 主要传播途径为经血传播、母婴传播、性传播
B. 发病多见于儿童
C. 周期性明显
D. 主要经水、食物及日常生活接触传播
E. 孕妇罹患率高，病死率高

正确答案：D。主要经水、食物及日常生活接触传播

解析：本题考查甲型肝炎及戊型肝炎的传播途径。甲型肝炎及戊型肝炎主要通过粪-口途径传播，常见的传播途径有：经食物传播、经水传播和日常生活接触传播（D对ABCE错）。